执业药师资格注册机构是
A. 国家药品监督管理部门
B. 国家人事部
C. 国家药品监督管理部门和人事部
D. 省药品监督管理部门
E. 省人事部门

正确答案：D。省药品监督管理部门

解析：本题考查执业药师。执业药师资格注册机构是省药品监督管理部门（D对）。执业药师资格实行注册制度，国家药品监督管理局负责执业药师注册的政策制定和组织实施，指导全国执业药师注册管理工作，各省、自治区、直辖市药品监督管理部门负责本行政区域内的执业药师注册管理工作。国家药品监督管理局（A错）为全国执业药师资格注册管理机构。国家药品监督管理部门和人事部（C错）是执业药师资格考试机构。